紫外-可见分光光度法常用的波长范围
A. 200～400nm
B. 400～760nm
C. 200～760nm
D. 760～2500nm
E. 2.5～25㎛

正确答案：C。200～760nm

解析：本题考查常用的药品鉴别方法。紫外-可见吸收光谱包括紫外光区与可见光区，波长范围为200nm～760nm（C对）。紫外光区波长范围为200nm～400nm（A错）。可见光区波长范围为400nm～760nm（B错）。近红外光区波长范围为760nm～2500nm（D错）。中红外光区波长范围为2.5μm～25μm（E错）。